某麻醉药品原植物种植单位擅自改变生产计划，扩大罂粟种植面积
A. 没收全部麻醉药品和非法所得、罚款或停业整顿
B. 以生产、贩卖毒品论处
C. 依照公安管理处罚条例处罚
D. 给予行政处分
E. 判二年以下徒刑

正确答案：A。没收全部麻醉药品和非法所得、罚款或停业整顿

解析：本题考查麻醉药品原植物种植单位的法律责任。麻醉药品原植物种植单位擅自改变生产计划，扩大罂粟种植面积应没收全部麻醉药品和非法所得、罚款或停业整顿（A对）。麻醉药品药用原植物种植企业违反本条例的规定，有下列情形之一的，由药品监督管理部门责令限期改正，给予警告；逾期不改正的，处5万元以上10万元以下的罚款；情节严重的，取消其种植资格：（一）未依照麻醉药品药用原植物年度种植计划进行种植的；（二）未依照规定报告种植情况的；（三）未依照规定储存麻醉药品的。